患儿，10岁。发育正常，无明显症状。听诊于胸骨左缘2、3肋间Ⅱ级收缩期杂音，心电图显示右心室肥厚及不完全性右束支传导阻滞。本例可能的诊断
A. 肺动脉狭窄
B. 法洛四联症
C. 室间隔缺损
D. 房间隔缺损
E. 右位心

正确答案：D。房间隔缺损